小儿蛋白质-能量营养不良最早期的临床表现是
A. 体重减轻
B. 皮下脂肪消失
C. 体重不增
D. 肌肉松弛
E. 身高增长停滞

正确答案：C。体重不增

解析：体重不增、体重减轻、皮下脂肪消失、肌肉松弛、身高增长停滞都是小儿蛋白质–能量营养不良的表现，最早表现为体重不增（C对），随着营养不良加重，体重减轻（A错），皮下脂肪消失（B错），皮肤失去弹性，肌张力减弱，肌肉松弛（D错），随病情加重，骨骼生长减慢，身高亦低于正常，此时身高增长停滞（E错）。